面对同样的社会应激，有人难以适应而得病，有人很快度过难关。医学心理学解释此现象的基本观点为
A. 社会影响的观点
B. 情绪作用的观点
C. 个性特征的观点
D. 心身统一的观点
E. 主动调节的观点

正确答案：C。个性特征的观点

解析：旧版教材中，医学心理学的6个基本观点为：心身统一的观点、社会对个体影响的观点、认知评价的观点、主动适应和调节的观点、情绪因素作用的观点、个性特征作用的观点。社会影响的观点（A错）是一个完整的个体不仅是生物的人，而且是社会的人，即人生活在一个多层次多等级的系统中。情绪作用的观点（B错）是指，情绪与健康有着十分密切的关系。认知评价的观点是指，心理社会因素能否影响健康或导致疾病，不完全取决于该因素的性质和意义，还取决于个体对外界刺激怎样认知和评价。个性特征的观点（C对）是指，面对同样的社会应激，有的人得病，难以适应，有的人则“游刃有余”，很快度过“难关”，这种现象与个性特征有着十分密切的关系，不同人有不同的个性特征，从而对同样的同样的应激有不同的结果。心身统一的观点（D错）是指一个完整的个体应包括心、身即精神与躯体两个部分，两者相互影响，对外界环境的刺激，心、身是作为一个整体来反应的。主动调节的观点（E错）是指个体在成长发育过程中，逐渐对外界事物形成了一个特定的反应模式，构成了相对稳定的个性特点，是使个体行为与外界保持相对和谐一致的主要因素。